药物制剂稳定性变化可分为物理性、化学性和生物性三大类。下列稳定性变化中属于物理性变化的是
A. 氧化变色
B. 水解沉淀
C. 沉降分层
D. 降解变色
E. 酶解霉败

正确答案：C。沉降分层

解析：本题考查药物制剂稳定性。物理变化包括混悬剂中药物颗粒结块、结晶生长，乳剂分层（C对）、破裂，胶体制剂的老化，片剂崩解度、溶出速度的改变等。